提示重症胰腺炎的体征是
A. Courvoisier征阳性
B. 肝浊音界消失
C. Grey-Turner征阳性
D. Murphy征阳性
E. 肝区叩击痛阳性

正确答案：C。Grey-Turner征阳性

解析：重症胰腺炎时，胰腺的出血可经腹膜后途径渗入皮下，可在腰、季肋、下腹部出现大片青紫瘀斑，称为Grey-Turner征，是重症胰腺炎的重要体征（C对）。Courvoisier征阳性（A错）指梗阻性黄疸伴无痛性胆囊肿大，提示胰头癌可能性大。肝浊音界消失（B错）提示急性胃肠穿孔，亦可见于明显胃肠胀气、间位结肠等。Murphy征阳性（D错）可见于急性胆囊炎。肝区叩击痛阳性（E错）见于肝炎、肝脓肿及肝癌等疾病。